癫痫持续状态的特点是
A. 癫痫发作或反复发作25分钟
B. 癫痫发作或反复发作30分钟
C. 癫痫发作或反复发作10分钟
D. 癫痫发作或反复发作15分钟
E. 癫痫发作或反复发作20分钟

正确答案：B。癫痫发作或反复发作30分钟

解析：癫痫持续状态指癫痫发作持续30分钟以上；或反复发作而发作间期意识不能恢复超过 30 分钟以上者。突然停药、药物中毒、更换药物不当或感染高热等是癫痫持续状态的常见诱因。癫痫持续状态是癫痫非常严重的一种临床表现形式，如果不给予积极治疗，有可能会引起呼吸心跳的骤停，引起大脑严重的供血、供氧不足，甚至危害患者的生命（B对）。